女，67岁，车祸后即昏迷，伤后2小时被送至医院。查体：昏迷状态，左顶枕部有一直径4cm头皮血肿，右侧瞳孔散大，对光反射消失，左侧肢体肌张力增高，病理反射阳性。头颅CT示右额颞部骨板下新月形高密度影。该患者最可能的诊断是
A. 右额颞急性硬脑膜下积液，脑疝
B. 右额颞急性硬脑膜外血肿，脑疝
C. 右额颞脑挫伤，脑疝
D. 右额颞脑内血肿，脑疝
E. 右额颞急性硬脑膜下血肿，脑疝

正确答案：E。右额颞急性硬脑膜下血肿，脑疝

解析：老年女性患者，车祸后持续昏迷，左顶枕部有一头皮血肿（提示可存在右额颞部对冲伤），右侧瞳孔散大，对光反射消失（提示右侧动眼神经受压），左侧肢体肌张力增高，病理反射阳性（提示右侧小脑幕切迹疝），头颅CT示右额颞部骨板下新月形高密度影（急性硬膜下血肿的典型影像学表现），结合患者病史、临床表现和影像学检查，最可能的诊断为右额颞急性硬脑膜下血肿，小脑幕切迹疝（E对）。急性硬脑膜下积液（A错）又称硬膜下水瘤，指硬脑膜下腔出现脑脊液积聚，主要表现为头痛、恶心、呕吐等颅内高压和局部脑组织受压的症状和体征，可有意识障碍，头颅CT表现为骨板下新月形低密度影。急性硬脑膜外血肿（P191）（B错）头颅CT的典型表现为颅骨内板与硬脑膜之间双凸镜形或弓形的高密度影。脑挫伤（P188）（C错）主要表现为头痛、呕吐、恶心及伤后立即发生的意识障碍，头颅CT表现为局部脑组织内高低密度混杂影。脑内血肿（P194）（D错）常与急性硬膜下血肿同时存在，但头颅CT表现为脑组织内类圆形或不规则的高密度影。